某患者，60岁。右下6因松动于三个月前拔除，要求修复。患者缺牙属于
A. 肯氏第一类
B. 肯氏第二类
C. 肯氏第三类
D. 肯氏第四类
E. 肯氏第一类第一亚类

正确答案：C。肯氏第三类

解析：本题考查局部义齿的设计。第三类（C对）：缺隙位于牙弓一侧，缺隙前后均有余留牙，即单侧非游离缺失。